临床最常见的子宫肌瘤是
A. 浆膜下肌瘤
B. 肌壁间肌瘤
C. 阔韧带肌瘤
D. 粘膜下肌瘤
E. 宫颈肌瘤

正确答案：B。肌壁间肌瘤

解析：子宫肌瘤按肌瘤与子宫肌壁的关系分为：肌壁间肌瘤、浆膜下肌瘤、粘膜下肌瘤；按肌瘤生长位置分为：宫体肌瘤和宫颈肌瘤。其中，宫体肌瘤最常见，占90%；其次为肌壁间肌瘤（B对），占60%-70%；其余依次为：浆膜下肌瘤（A错）约占20%，粘膜下肌瘤（D错）占10%-15%，宫颈肌瘤（E错）占10%。阔韧带肌瘤（C错）是浆膜下肌瘤中生长突出于阔韧带两叶之间者。